母体抗体进入胎儿体内可提供哪一类免疫
A. 自然自动免疫
B. 自然被动免疫
C. 人工自动免疫
D. 人工被动免疫
E. 被动自动免疫

正确答案：B。自然被动免疫